目前，所有研究釉质龋的病理变化，是从研究哪种龋病而来
A. 窝沟龋
B. 邻面龋
C. 牙颈部龋
D. 平滑面龋
E. 根面龋

正确答案：D。平滑面龋

解析：虽然临床上以点隙窝沟龋最常见，但是由于点隙窝沟解剖结构的复杂性，干扰了人们对釉质龋组织形态学的观察，故目前对于釉质龋的病理变化、病变过程的理解大都是从研究平滑面龋得来的。掌握“牙釉质龋”知识点。